用于耐青霉素的金葡菌引起的严重感染的药物是
A. 万古霉素
B. 克林霉素
C. 克拉霉素
D. 红霉素
E. 阿奇霉素

正确答案：A。万古霉素

解析：本题考查万古霉素。万古霉素（A对）属于糖肽类抗菌药物，临床主要用于耐金黄色葡萄球菌或对β-内酰胺类抗菌药物过敏的严重感染。克林霉素（B错）对各类厌氧菌具有良好抗菌作用。克拉霉素（C错）与奥美拉唑-替硝唑合用治疗幽门螺杆菌引起的胃溃疡。红霉素（D错）用于耐青霉素的金葡菌引起的轻、中度感染或青霉素过敏者。阿奇霉素（E错）适用于化脓性链球菌引起的急性咽炎、急性扁桃体炎，敏感细菌引起的鼻窦炎、中耳炎。